用基准无水碳酸钠标定硫酸滴定液时，已知碳酸钠（Na₂CO₃）的分子量为106.0，1ml硫酸滴定液（0.05mol/L）相当于无水碳酸钠的毫克数为
A. 106
B. 10.6
C. 53
D. 5.3
E. 0.53

正确答案：D。5.3